患者，男，76岁。小便失禁，精神倦怠，少气懒言，面色无华，舌淡苔薄白，脉弱无力。诊为前列腺增生症，其证候是
A. 肾阳不足，气化失权
B. 肺失治节，水道不利
C. 湿热下注，膀胱涩滞
D. 肾阴不足，水液不利
E. 中气下陷，膀胱失约

正确答案：E。中气下陷，膀胱失约

解析：前列腺增生症，是老年男性的常见疾病之一，临床特点以尿频、夜尿次数增多、排尿困难为主，严重者可发生尿潴留或尿失禁，甚至出现肾功能受损，中焦脾胃气虚，不能收摄，膀胱失于约束，水不能蓄，出现小便失禁；气虚不能维持正常的精神活动，出现精神倦怠，少气懒言；气虚无力推动血液行于头面，出现面色无华；舌淡苔薄白，脉弱无力，为气虚之象，故本病例证型为中气下陷，膀胱失约（E对）。肾阳不足，气化失权证，其症候为小便失禁或尿不出，精神萎靡，腰酸膝冷，面色晄白，畏寒喜暖，舌淡苔白，脉沉细或迟弱（A错）。肺失治节，水道不利证，症候为除小便不畅、甚至点滴不通外，兼有咽干、口燥、呼吸不利、咳嗽痰喘等症状（B错）。湿热下注，膀胱涩滞证，症候特点为小便频数不爽，尿黄而热，茎中痒痛，甚则尿闭不通，小腹急胀，舌红苔腻或黄腻，脉数（C错）。肾阴不足，水液不利证，症候特点为小便频数不爽，淋漓不尽，伴有头晕目眩、腰膝酸软、失眠多梦，阴虚有热者，舌红咽干、尿黄而热，脉象细数（D错）。